受检查者由于主观或客观原因未能接受检查的是
A. 选择性偏倚
B. 无应答偏倚
C. 测量偏倚
D. 回忆偏倚
E. 检查者偏倚

正确答案：B。无应答偏倚

解析：本题考查口腔健康状况调查的样本含量及误差。此题由于调查对象没有接受检查，而使调查结果出现与实际结果不一致的情况，称为无应答偏倚（B对）。